非特异性菌斑学说的主要依据
A. 菌斑提取物可致动物皮下脓肿
B. 菌斑、牙石多者，牙龈炎症较重
C. 清除菌斑、牙石可减轻炎症程度
D. 菌斑总体微生物联合致病
E. 以上都是

正确答案：E。以上都是

解析：本题考查非特异性菌斑学说的主要依据。牙周病的菌斑学说有非特异性菌斑学说、特异性菌斑学说、菌群失调学说。非特异菌斑学说强调细菌的量，为菌斑总体微生物联合致病（D对）。菌斑、牙石多者，牙龈炎症较重（B对），因此当清除菌斑、牙石可减轻炎症程度（C对）。将健康者或牙周病患者的牙菌斑悬液接种于动物皮下，均可引起局部脓肿（A对）认为牙周病不是一种微生物引起的疾病，即由非特异性的口腔菌群混合感染所致。（ABCD均对，故E为本题的正确答案）。